不属于济川煎药物组成的是
A. 芍药
B. 牛膝
C. 泽泻
D. 升麻
E. 枳壳

正确答案：A。芍药

解析：济川煎药物组成的是当归、牛膝、肉苁蓉、泽泻、升麻、枳壳（济川归膝肉苁蓉，泽泻升麻枳壳从，肾虚津亏肠中燥，寓通于补法堪宗）（A错，为本题正确答案）。